脾的生理功能不包括
A. 主运化
B. 主统血
C. 主升清
D. 主肃降
E. 化生气血

正确答案：D。主肃降

解析：本题考查的是脾的生理功能。脾的生理功能不包括主肃降（D错，为本题正确答案）。脾的生理功能。脾的生理功能主要有两方面：一是主运化（A对），二是主统血（B对）。1.脾主运化：（1）运化水谷精微，是指脾对饮食物的消化和水谷精微的吸收、转输、布散的作用。饮食物由胃受纳腐熟，必须依赖于脾的运化功能，才能将水谷转化为精微物质，转输到心肺，布散于全身，从而使各个脏腑、组织、器官得到充足的营养，并通过心肺的作用化生气血（E对），故“脾为后天之本，气血生化之源”。（2）运化水液，是指脾对水液的吸收、转输和布散作用。2.脾主统血：脾主统血，是指脾能统摄、控制血液，使之正常地循行于脉内，而不逸出于脉外。脾主升清与胃主降浊与气的运行有关。气的运行，称作“气机”，“升降出入”是气运动的基本形式。气的升降出入运动体现在脏腑、经络、形体、官窍的功能活动中。例如，肺主呼吸，有出有入，有宣有降，肺主呼气（出）、肾主纳气（入），心火下降、肾水升腾，以及脾主升清、胃主降浊等。